下列选项，不是血虚证临床表现的是
A. 经少经闭
B. 头晕眼花
C. 心烦失眠
D. 面色淡白
E. 肢体麻木

正确答案：C。心烦失眠

解析：患者血液亏虚，不能濡养头目，上荣舌面，故面色淡白（D对）或萎黄，口唇、眼睑色淡，头晕眼花（B对）；女子以血为用，血虚致血海空虚，冲任失充，故月经量少色淡或经闭（A对）；血少不能濡养筋脉、肌肤，故手足麻木（E对），爪甲色淡。心阴虚时，虚热扰心，神不守舍，可见心烦失眠（C错，为本题正确答案）。